以下哪项不是基托缓冲的目的
A. 防止压痛
B. 防止有碍发音
C. 防止压迫牙龈
D. 防止压伤黏膜组织
E. 防止基托翘动

正确答案：B。防止有碍发音

解析：发音障碍：一般情况下，全口义齿初戴时，常发音不清楚，但很快就能够适应和克服。如牙齿排列的位置不正确就会使发音不清或有哨音。哨音产生的原因是由于后部牙弓狭窄，舌活动受限，使舌背与腭面之间形成很小的空气排溢道而造成的；基托前部的腭面太光滑，前牙舌面过于光滑也可造成哨音。可将上颌基托前部形成腭皱和切牙乳突的形态，形成上前牙舌面隆凸、舌面窝和舌外展隙的形态。如果下前牙排列的过于向舌侧倾斜，使舌拱起得较高，可使空气逸出道变小，而造成哨音。如下颌前部舌侧基托太厚，也会使发“s”音不清楚。修改方法可将下颌前牙稍向唇侧倾斜，将下颌舌侧基托磨薄些，使舌活动间隙加大，与缓冲无关。掌握“全口义齿戴入后问题及处理”知识点。